下列哪种方式不能预防术后下肢深静脉血栓形成
A. 口服阿司匹林
B. 口服华法林
C. 皮下注射低分子肝素
D. 静脉注射普通肝素
E. 术后及早下床活动

正确答案：A。口服阿司匹林

解析：下肢深静脉血栓的形成的高危因素是手术、制动、血液高凝状态，故术后病情稳定后及早下床运动（E对）是预防血栓形成的有效措施。同时，抗凝血疗法是用药物降低血液的凝固型，是预防和治疗血栓闭塞性疾病的方法，抗凝药物主要由普通肝素（静脉滴注）（D对）、低分子肝素（皮下注射）（C对）及华法林（口服）（B对）等。口服阿司匹林（A错，为本题正确答案）属于抗血小板疗法，主要用于防治动脉闭塞性疾病，同时也是静脉闭塞性疾病的辅助治疗，特别是对抗凝或溶栓疗法有禁忌的患者宜选用抗血小板疗法。